下列属于学校对青少年健康危害行为起保护作用的因素是
A. 教师不良教育行为
B. 学习负担过重
C. 学校压力过大
D. 同学关系紧张
E. 师生关系融洽

正确答案：E。师生关系融洽